与子宫内膜不规则脱落无关的是
A. 黄体萎缩不全时，子宫内膜脱落不全
B. 月经期第5～6日，仍能见到呈分泌反应的子宫内膜
C. 月经周期正常，但经期延长，甚至可达10日以上，且出血量多
D. 基础体温双相，但下降缓慢
E. 基础体温双相型，但排卵后体温上升缓慢，上升幅度偏低，维持时间短于11日

正确答案：E。基础体温双相型，但排卵后体温上升缓慢，上升幅度偏低，维持时间短于11日

解析：基础体温双相型，但排卵后体温上升缓慢，上升幅度偏低，维持时间短于11日是黄体功能不全的特点。掌握“功能失调性子宫出血”知识点。